寒哮之痰是
A. 痰稀薄色白，咯吐不爽
B. 痰黄或白，黏浊稠厚难咯
C. 痰脓腥臭
D. 痰多夹杂腐肉
E. 痰如白沬，夹有血丝

正确答案：A。痰稀薄色白，咯吐不爽

解析：寒哮即冷哮，其病机为寒痰伏肺，遇感触发，痰升气阻，肺失宣畅。寒哮之痰因肺失宣降，聚津为痰，故表现为痰少咯吐不爽，痰稀薄色白（A对）。痰黄或白，黏浊稠厚难咯（B错）可见于热哮证。痰脓腥臭（C错）、痰多夹杂腐肉（D错）可见于肺痈。痰如白沬，夹有血丝（E错）可见于肺痨。